添加软饭、碎肉、带馅食品等碎状食物应在
A. 10～12个月
B. 1～3个月
C. 4～6个月
D. 7～9个月
E. 12～15个月

正确答案：A。10～12个月

解析：10～12个月：碎状食物，如粥、软饭、烂面条、豆制品、碎菜、碎肉、带馅食品等。掌握“婴儿喂养方法”知识点。